妊娠期妇女常用的口腔健康教育方法包括
A. 社区讲座
B. 图书阅览
C. 社区医师面对面的健康咨询
D. 播放口腔宣传片
E. 以上全部包括

正确答案：E。以上全部包括

解析：妊娠期妇女常用的口腔健康教育方法有：社区讲座、图书阅览、社区医师面对面的健康咨询、播放口腔宣传片、免费发放孕期口腔健康知识手册等。掌握“妊娠期妇女口腔保健”知识点。